在复发性阿弗他溃疡全身治疗中，正确使用肾上腺皮质激素类药物的方法是
A. 泼尼松10～30mg/d，分3次口服，溃疡控制后逐渐减量
B. 泼尼松60mg/d，分3次口服，控制病情后减量
C. 泼尼松60～80mg/d，分3次口服，控制病情后减量
D. 泼尼松80～100mg/d，分3次口服，控制病情后减量
E. 泼尼松100～120mg/d，分3次口服，控制病情后减量

正确答案：A。泼尼松10～30mg/d，分3次口服，溃疡控制后逐渐减量

解析：复发性阿弗他溃疡应用激素治疗的正确方法是：泼尼松10～30mg/d，分3次口服，溃疡控制后逐渐减量。掌握“复发性阿弗他溃疡”知识点。